下列各组腧穴中，两穴相距1寸的是
A. 中脘、神阙
B. 中极、关元
C. 中极、气海
D. 内关、郄门
E. 气海、关元

正确答案：B。中极、关元

解析：中极位于脐正下方4寸，关元位于脐正下方3寸，相距1寸（B对）。中脘在脐正上方4寸，神阙位于脐中，相距4寸（A错）。中极位于脐正下方4寸，气海位于脐正下方1.5寸，相距2.5寸（C错）。内关位于腕掌侧远端横纹上2寸，郄门位于腕掌侧远端横纹上5寸，相距3寸（D错）。气海位于脐正下方1.5寸，关元位于脐正下方3寸，相距1.5寸（E错）。